卫生事业的生产性包括
A. 物质资料的生产和人类自身的生产
B. 人类自身的生产和产品的生产
C. 物资资料的生产和药品的生产
D. 原材料的生产和人类自身的生产

正确答案：A。物质资料的生产和人类自身的生产

解析：本题考查卫生事业的生产性。卫生事业的生产性包括：物质资料的生产和人类自身的生产（A对BCD错）。